乳糜池通常位于
A. 第12胸椎体前方
B. 第1腰椎体前方
C. 第2腰椎体前方
D. 第3腰椎体前方
E. 第2~3腰椎体前方

正确答案：B。第1腰椎体前方

解析：乳糜池位于第1腰椎体前方（B对），胸导管自第12胸椎下缘起自乳糜池（A错）。